呈方形或不规则块状，表面棕褐色或黑褐色，光滑而稍具光泽，质硬，易碎，有细孔遇潮有黏性，气微味涩、苦略回甜的药材是
A. 没药
B. 儿茶
C. 血竭
D. 乳香
E. 冰片

正确答案：B。儿茶

解析：本题考查的是儿茶药材的性状鉴别。呈方形或不规则块状，表面棕褐色或黑褐色，光滑而稍具光泽，质硬，易碎，有细孔遇潮有黏性，气微味涩、苦略回甜的药材是儿茶（B对）。儿茶：【性状鉴别】药材呈方形或不规则块状，大小不一。表面棕褐色或黑褐色，光滑而稍具光泽。质硬，易碎，断面不整齐，具光泽，有细孔，遇潮有黏性。气微，味涩、苦，略回甜。取火柴杆浸于本品水浸液中，使轻微着色，待干燥后，再浸入盐酸中立即取出，置火焰附近烘烤，杆上即显深红色。没药（A错）：【性状鉴别】药材天然没药呈不规则颗粒性团块，大小不等，大者长达6cm以上。表面黄棕色或红棕色，近半透明部分呈棕黑色，被有黄色粉尘。质坚脆，破碎面不整齐，无光泽。有特异香气，味苦而微辛。血竭（C错）：【性状鉴别】药材略呈类圆四方形或方砖形，表面暗红色，有光泽，附有因摩擦而成的红粉。质硬而脆，破碎面红色。研粉为砖红色。气微、味淡。乳香（D错）：【性状鉴别】药材呈长卵形滴乳状、类圆形颗粒或黏合成大小不等的不规则块状物。大者长达2cm（乳香珠）或5cm（原乳香）。表面黄白色，半透明，被有黄白色粉末，久存则颜色加深。质脆，遇热软化。破碎面有玻璃样或蜡样光泽。具特异香气，味微苦。冰片（E错）：【性状鉴别】药材为无色透明或白色半透明的片状松脆结晶。气清香，味辛、凉。具挥发性，点燃发生浓烟，并有带光的火焰。本品在乙醇、三氯甲烷或乙醚中易溶，在水中几乎不溶。熔点为205℃～210℃。